女，35岁，已婚。10小时前出现上腹部胀痛，6小时前疼痛转移至右下腹，伴恶心、呕吐、发热。查体：右下腹压痛、反跳痛阳性，肠鸣音减弱。血常规：白细胞总数及中性粒细胞分类升高。早期的最佳治疗方法是
A. 抗生素治疗、温水坐浴及温盐水灌肠
B. 经直肠切开引流
C. 经阴道切开引流
D. 超声引导下腹腔穿刺
E. 经腹部切开引流

正确答案：A。抗生素治疗、温水坐浴及温盐水灌肠